使用可摘局部义齿最容易造成疼痛的部位不包括
A. 尖牙唇侧
B. 牙槽嵴顶
C. 上颌隆突
D. 上颌结节颊侧
E. 内斜嵴处

正确答案：B。牙槽嵴顶

解析：本题考查使用可摘局部义齿最容易造成疼痛的部位。牙槽嵴顶（B错，为本题的正确答案）表面覆盖着高度角化的复层鳞状上皮，其下有致密的黏膜下层所附着，能承受咀嚼压力，抵抗义齿基托的碰撞而不致造成组织的创伤，使用可摘局部义齿后正常情况下不会出现疼痛。使用可摘局部义齿最容易造成疼痛的部位：①基牙唇侧（A对），尤其是卡环臂与基牙接触的牙颈部，可因卡环过紧，与基牙产生过度摩擦和推力导致基牙疼痛；②上颌隆突（C对）即硬区、上颌结节颊侧（D对）、内斜嵴处（E对）等骨性隆突区，这些部位不仅骨质突起，而且表面覆盖很薄的黏膜，弹性差，不能承受咀嚼压力。